易导致血糖异常的药品是
A. 庆大霉素
B. 加替沙星
C. 多西环素
D. 头孢哌酮
E. 阿莫西林

正确答案：B。加替沙星

解析：本题考查加替沙星的不良反应。血糖紊乱是加替沙星（B对）的典型不良反应。加替沙星会促进胰岛素的释放使血糖下降；又可使胰岛细胞空泡化使血糖升高。庆大霉素（A错）不良反应是耳毒性，对血糖没有影响。多西环素（C错）不良反应是牙齿黄染。头孢哌酮（D错）的不良反应是双硫仑样反应。阿莫西林（E错）的不良反应是过敏反应。